潮热颧红，舌红少苔脉细数，尿妊娠试验阴性。其治法是
A. 养阴清热调经
B. 理气活血通经
C. 豁痰活血通经
D. 益气养血调经
E. 补肾养肝调经

正确答案：A。养阴清热调经

解析：患者月经近半年来月经后期，经量少，现已停经4个月，尿妊娠试验阴性，排除妊娠的存在，月经周期延后渐至月经停闭4月属于继发性闭经；阴血亏虚，日久益甚，虚热内生，火逼水涸，血海燥涩渐涸，故月经延后，量少，色红质稠，渐至月经停闭；阴虚日久，虚火内灼，故出现五心烦热，颧红口干，虚热内扰，蒸经外泄则盗汗，骨蒸劳热，舌红少苔脉细数均为阴虚内热之象，属于闭经之阴虚血燥证，治宜养阴清热调经（A对）。肝气郁结，气行则血行，气结则血瘀，气滞血瘀，瘀阻冲任，月经停闭，治当理气活血，祛瘀通经（B错）。脾虚运化失司，聚湿生痰，瘀滞冲任，有碍血海满盈，月经停闭，治疗应健脾燥湿化痰，活血调经（C错）。气血亏虚，冲任不充，不能按时满溢，故月经周期延长渐至月经停闭，治疗应益气养血调经（D错）。肝肾阴虚，冲任损伤，血海空虚致月经周期延长，渐至月经停闭，治当补肾养肝调经（E错）。